下列属于哌唑嗪作用的是
A. 有利尿作用
B. 有降压作用
C. 两者皆有
D. 两者皆无

正确答案：B。有降压作用

解析：本题考查哌唑嗪。下列属于哌唑嗪作用的是有降压作用（B对）。哌唑嗪为α₁受体阻断剂，舒张小动脉和静脉，对立位和卧位血压均有降低作用。适用于各型高血压，单用治疗轻、中度高血压，重度高血压合用利尿药和β受体阻断药可增强降压效果。可阻断膀胱颈、前列腺包膜和腺体、尿道等处α₁受体，改善前列腺肥大患者排尿困难症状，因此适宜用于高血压合并前列腺肥大者。